患者，男，20岁。反复咳嗽，咳痰量多已2年。今天突然咯鲜血300ml，无发热，不消瘦。听诊：右下肺闻及小水泡音。应首先考虑的是
A. 大叶性肺炎
B. 肺结核
C. 支气管扩张
D. 风湿性心脏病二尖瓣狭窄
E. 肺脓肿

正确答案：C。支气管扩张

解析：患者青年男性，反复咳嗽，咳痰量多已2年今天突然咯鲜血300ml，无发热，不消瘦。听诊：右下肺闻及小水泡音，患者临床表现与支气管扩张症相符，故患者应首先考虑的是支气管扩张（C对）。大叶性肺炎（P46）（A错）常有受凉、淋雨史，主要表现为高热、寒战、咳嗽、咳粉红色泡沫痰等症状。肺结核（P61）（B错）主要表现为乏力、低热、盗汗等结核分枝杆菌感染中毒症状。风湿性心脏病二尖瓣狭窄（P298）（D错）主要表现为呼吸困难、咳嗽、咯血、血栓栓塞等。肺脓肿（P57）（E错）主要表现为咳嗽、咳黏液痰或黏液脓性痰。